需要维生素D缺乏性佝偻病鉴别的疾病是
A. 脑积水
B. 黏多糖病
C. 软骨营养不良
D. 先天性甲状腺功能减退症
E. 以上均是

正确答案：E。以上均是

解析：佝偻病体征的鉴别：即与非佝偻病性疾病鉴别。①先天性甲状腺功能减退症；②软骨营养不良；③黏多糖病；④脑积水。掌握“维生素D缺乏性佝偻病”知识点。